流行性出血热病理损害最明显的器官是
A. 心脏
B. 肝脏
C. 脑实质
D. 肾脏
E. 肺

正确答案：D。肾脏

解析：流行性出血热又称肾综合征出血热，主要的病理变化是全身小血管和毛细血管广泛性损害，临床上以发热、低血压休克、充血出血和肾损害为主要表现，其中小血管和肾脏（D对）病变最明显，其次为心（A错）、肝（B错）、脑（C错）、肺（E错）等脏器。